成人失血100毫升时
A. 血压升高，心率加快
B. 血压降低，心率加快
C. 血压升高，心率减慢
D. 血压降低，心率减慢
E. 心率和血压均无变化

正确答案：E。心率和血压均无变化

解析：成人失血100毫升（低于总血容量的10%，即500ml），完全可以通过机体自身代偿保持心率、血压的稳定，而不发生明显变化（E对）。